关于子宫下段的说法错误的是
A. 临产后长达7-10cm
B. 由非妊娠时的子宫峡部伸展形成
C. 位于宫颈内口与外口之间
D. 临产后是软产道的一部分
E. 至妊娠晚期形成

正确答案：C。位于宫颈内口与外口之间

解析：宫颈内口与外口之间为宫颈管（C错，为本题正确答案）。妊娠期母体变化最大的器官是子宫，主要表现为体积增大、血流量增加和子宫下段形成。子宫下段为非孕时的子宫峡部（B对）在妊娠12周后逐渐伸展变长，扩展成宫腔一部分，至妊娠晚期被逐渐伸展变长形成（E对）（P171-172）。子宫峡部临产后伸展至7～10cm（A对），成为产道一部分（D对），称为子宫下段，是产科手术学的重要解剖结构。